太阴风温温热冬温，初起恶风寒者，治宜选用
A. 麻杏石甘汤
B. 桑杏汤
C. 桂枝汤
D. 栀子豉汤
E. 宣白承气汤

正确答案：C。桂枝汤

解析：风温、温热、温疫、冬温等4种温病初起，皆可表现为邪在肺卫。吴鞠通以“恶风寒”和“不恶寒”来区分使用辛温与辛凉之剂。恶风寒较明显者，是表邪偏盛，可借辛温之剂外散表邪，但不可过用辛温峻汗之剂，以免助热化燥。方选桂枝汤，桂枝汤微辛微温，其开肌腠，和营通络，解散外风，打开郁闭之表（C对）。